引导性组织再生术中屏障膜的作用
A. 隔离牙龈上皮进入骨缺损区
B. 隔离结缔组织与根面接触
C. 在膜与根面之间形成一个新附着的空间
D. 保护血凝块
E. 以上都是

正确答案：E。以上都是

解析：本题考查引导性组织再生术中屏障膜的作用。引导性组织再生术的目的是使牙周袋消除，已破坏的牙周组织得以重建，即有新的牙骨质和牙槽骨形成，其间有新的牙周膜纤维将其连接，形成有功能性的牙周附着结构。在愈合过程中，牙龈上皮、牙龈结缔组织、牙周膜、牙槽骨这4种来源的先后向根面生长贴附，最终的愈合方式取决于这4种细胞的生长速度和条件。一般情况下，牙龈上皮生长速度最快，首先占据根面形成长结合上皮愈合，并阻止其他组织与根面附着，这是最常见的愈合方式，牙龈结缔组织的生长速度仅次于牙龈上皮，牙槽骨细胞生长速度最慢。牙周膜细胞的生长速度次于牙龈上皮和牙龈结缔组织，因此引导性组织再生术中利用屏障膜的作用是：隔离牙龈上皮进入骨缺损区（A对），隔离结缔组织与根面接触（B对），在膜与根面之间形成一个新附着的空间（C对），使牙周膜细胞优先占领根面，保护血凝块（D对）为牙周膜细胞的生长提供营养。（ABCD均对，故E为本题的正确答案）。